增液汤的组成药物中含有
A. 党参
B. 白参
C. 玄参
D. 沙参
E. 丹参

正确答案：C。玄参

解析：该题考查增液汤的组成。增液汤功能增液润燥，由玄参、麦冬、生地黄组成（C对）。